肉芽组织的作用不包括
A. 抗感染创面
B. 填补创口和组织缺损
C. 机化渗出物
D. 包裏渗出物
E. 连接组织缺损，保持器官完整性

正确答案：E。连接组织缺损，保持器官完整性

解析：肉芽组织在组织损伤修复过程中的作用有：抗感染保护创面（A对）、填补创口和组织缺损（B对）、机化和包裹炎性渗出物（CD对）等。连接组织缺损，保持器官完整性（E错，为本题正确答案）是瘢痕组织对机体的作用。